患者胸骨下部显著前突，左、右胸廓塌陷，肋骨与肋软骨交界处变厚增大，上下相连呈串珠状。其诊断是
A. 肺结核
B. 佝偻病
C. 肺气肿
D. 支气管哮喘
E. 肺纤维化

正确答案：B。佝偻病

解析：患者胸骨下部显著前突，左、右胸廓塌陷（鸡胸），肋骨与肋软骨交界处变厚增大，上下相连呈串珠状（佝偻病串珠）。患者有典型的鸡胸及佝偻病串珠，诊断为佝偻病（B对）。